女，52岁。半年前发现右乳腺肿物，发现时大小约2cmx1.5cm，无疼痛，质硬，活动度小。近来肿块扩展至乳房大部，整个乳房增大、红肿、充血、水肿、发热、质硬。假设诊断为乳腺癌，首先考虑如何治疗
A. 乳腺癌根治术
B. 化疗
C. 内分泌治疗
D. 局部放疗
E. 抗感染治疗

正确答案：B。化疗